以硅胶为固定相的薄层色谱按作用机制属于
A. 吸附色谱
B. 离子交换色谱
C. 胶束色谱
D. 分子排阻色谱
E. 亲合色谱

正确答案：A。吸附色谱